青少年一日三餐合适的热量分配比例是
A. 早餐20%，中餐60%，晚餐20%
B. 早餐30%，中餐40%，晚餐30%
C. 早餐40%，中餐40%，晚餐20%
D. 早餐30%，中餐50%，晚餐20%
E. 早餐20%，中餐50%，晚餐30%

正确答案：B。早餐30%，中餐40%，晚餐30%